患者，男，64岁，自述乏力、心悸、肢体麻木，查体发现其“牛肉样舌”、共济失调、深感觉障碍，诊断为巨幼细胞贫血，给予叶酸治疗。推荐的用法、用量是
A. 0.3g tid
B. 20mg tid
C. 0.5g qd
D. 0.4mg qd
E. 5mg tid

正确答案：E。5mg tid

解析：本题考查叶酸的用法用量。推荐的用法用量是5mg tid（E对）。叶酸临床用于：（1）口服0.4mg规格：①预防胎儿先天性神经管畸形。②妊娠期、哺乳期妇女预防用药。（2）口服5mg规格：①各种原因引起的叶酸缺乏及叶酸缺乏所致的巨幼红细胞贫血。②妊娠期、哺乳期妇女预防给药。③慢性溶血性贫血所致的叶酸缺乏。（3）注射剂：用于各种原因引起的叶酸缺乏及叶酸缺乏所致的巨幼红细胞贫血。